在某化疗药物治疗肺癌的临床随访研究中，不属于截尾数据的是
A. 随访对象死于其它疾病
B. 随访对象因在随访期间移民出国
C. 随访对象因严重副作用未能完成治疗
D. 随访对象到研究结束时仍未死亡
E. 随访对象失去联络

正确答案：B。随访对象因在随访期间移民出国

解析：本题考查截尾数值的产生原因。截尾数据的产生原因有：①失访，由于患者变更联系方式（E对）、未继续就诊（C对）或拒绝访问等原因，无法继续随访，未能观察到终点事件；②退出，患者死于其他疾病（A对）或因其他原因死亡（如死于车祸）而终止观察；③终止，研究结束时终点事件尚未发生（D对）。随访对象因在随访期间移民出国（B错，为本题正确答案）未必会影响随访过程而使随访被迫中止，因此该数据不属于截断数据。